关于女性生殖道防御机制的描述，正确的是
A. 阴道黏膜为柱状上皮，抗感染力强
B. 正常阴道菌群以乳酸杆菌和大肠杆菌为主
C. 两侧大阴唇自然合拢，防止外界污染
D. 妇女正常月经可增加宫腔感染的机会
E. 阴道正常为碱性环境，可抑制病原体生长

正确答案：C。两侧大阴唇自然合拢，防止外界污染

解析：两侧大阴唇自然合拢，遮掩阴道口、尿道口，从而防止外界污染（C对）。阴道黏膜由非角化复层鳞状上皮覆盖（P6）（A错），抗感染能力强。正常阴道微生物群中，以将单糖转化为乳酸的乳杆菌为主，乳杆菌通过维持阴道酸性环境（E错）和产生抗微生物因子抑制致病微生物（如大肠埃希菌）（P245）（B错）的生长。妇女的子宫内膜周期脱落形成月经，月经从子宫、阴道流出，会带走一部分细菌，可消除宫腔感染（P258）（D错）。